通过改变虫体肌细胞膜的离子通透性发挥驱虫作用，适用于儿童，常见制剂为宝塔糖的药品是
A. 青蒿素
B. 氯喹
C. 哌嗪
D. 噻嘧啶
E. 吡喹酮

正确答案：C。哌嗪

解析：本题考查哌嗪。通过改变虫体肌细胞膜的离子通透性发挥驱虫作用，适用于儿童，常见制剂为宝塔糖的药品是哌嗪（C对）。哌嗪对蛔虫和蛲虫均有较强的作用，它通过改变虫体肌细胞膜的离子通透性，使肌细胞超极化，减少自发电位发生，使蛔虫肌肉松弛，虫体不能在肠壁附着而随粪便排出体外。青蒿素（A错）为有效的抗疟药，通过产生自由基，破化疟原虫的生物膜、蛋白质等，最终导致虫体死亡；氯喹（B错）的抗疟机制则较为复杂，一般认为它能抑制虫体DNA的复制和转录，同时干扰虫体体内环境，使疟原虫分解和利用血红蛋白的能力降低，从而抑制疟原虫繁殖；噻嘧啶（D错）可用于治疗蛔虫，同时也可治疗蛲虫和钩虫，其主要机制为抑制虫体胆碱酯酶，造成神经肌肉接头处乙酰胆碱堆积，使虫体肌肉麻痹而排出体外；广谱抗蛔虫药吡喹酮（E错）对各类蠕虫均有较好的作用，服用后可影响虫体的吸收与排泄功能，并令虫体表面抗原暴露，而易受宿主的免疫系统攻击，促使虫体死亡。